下列溃疡中愈合后会留下瘢痕的是
A. 轻型阿弗他溃疡
B. 重型阿弗他溃疡
C. 疱疹样阿弗他溃疡
D. 白塞病口腔溃疡
E. 以上均会

正确答案：B。重型阿弗他溃疡

解析：本题考查愈合后会留下瘢痕的溃疡。重型复发性阿弗他溃疡（B对）亦称复发性坏死性黏膜腺周围炎或腺周口疮，溃疡深达黏膜下层，愈合后可形成瘢痕或组织缺损，故也称复发性瘢痕性口疮。轻型阿弗他溃疡（A错）和疱疹样阿弗他溃疡（C错）约10—14天溃疡愈合，不留瘢痕。白塞病口腔溃疡（D错）症状和发作规律与复发性阿弗他溃疡类似，多表现为轻型或疱疹样型，亦可为重型，只有在表现为重型时愈合后才会留下瘢痕，所以白塞病口腔溃疡愈合后不一定留下溃疡。